胺碘酮的药理作用是
A. 增加心肌耗氧量
B. 明显延长心肌不应期
C. 增加心肌自律性
D. 加快心肌传导
E. 收缩冠状动脉

正确答案：B。明显延长心肌不应期

解析：胺碘酮的作用属于Ⅲ类延长动作电位时程的药物，是广谱的抗心律失常药，阻滞钾通道，抑制钾离子外流，明显延长APD及ERP（B对）。抑制心脏多种离子通道，降低窦房结、浦肯野纤维的自律性和传导性（CD错）。还可以非竞争性拮抗肾上腺素受体和舒张、血管平滑肌作用，能扩张冠状动脉（E错）、增加冠脉流量、降低心肌耗氧量（A错）。